既能补益肝肾，强筋健骨，又能止血安胎，疗伤续折的药物是
A. 杜仲
B. 牛膝
C. 续断
D. 土鳖虫
E. 自然铜

正确答案：C。续断

解析：续断的功效补益肝肾，强筋筋骨，止血安胎，疗伤续折。（C对）。杜仲的功效是补肝肾，强筋骨，安胎（A错）。牛膝的功效活血通经，补肝肾，强筋骨利水通淋，引火（血）下行（B错）。土鳖虫的功效破血逐瘀，续筋接骨（D错）。自然铜的功效散瘀止痛，接骨疗伤（E错）。